某女，51岁。因反复胸闷、胸痛2年余就诊，2年前因琐事与人争吵后，出现左前胸胀痛，伴胸胁胀痛，心悸，休息后缓解，未予重视。此后，胸闷胸痛反复发作，多于情绪波动后症状加重，严重时可放射至左后肩。患者情志抑郁，善太息，纳差，寐欠安，小便黄，大便失调，唇舌紫暗，脉弦涩。既往有慢性乙型肝炎10余年，对酒精过敏。临床给予血脂、肝肾功能、心肌酶谱、心电图及平板运动试验等检查。西医诊断为冠心病心绞痛；中医诊断为胸痹，辨证为气滞血瘀证。处方如下：中药汤剂：柴胡10g，赤芍10g，炒枳壳10g，生甘草10g，桃仁10g，红花9g，生地黄15g，川牛膝10g，当归9g，党参15g，炙乳没（各）6g，桔梗9g，川楝子15g，延胡索粉（分冲）3g。共5剂，水煎服，每日1剂，早、晚分服。中成药：血府逐瘀口服液10ml×12支，每次10ml，3次/日；复方丹参滴丸25mg×100丸，10丸/次，3次/日；速效救心丸40mg×100丸，舌下含服10粒，必要时服用；茵栀黄口服液10ml×10支，每次10ml，3次/日。对上述处方用药的合理性分析，正确的是
A. 汤剂与复方丹参滴丸同时服用，属于重复用药
B. 汤剂与血府逐瘀口服液同时服用，属于重复用药
C. 汤剂与速效救心丸同时服用，属于重复用药
D. 汤剂与茵栀黄口服液同时服用，属于重复用药
E. 复方丹参滴丸与茵栀黄口服液同时服用，属于重复用药

正确答案：B。汤剂与血府逐瘀口服液同时服用，属于重复用药

解析：本题考查的是中药方剂的组成。汤剂（血府逐瘀汤）与血府逐瘀口服液同时服用，属于重复用药（B对）。血府逐瘀汤（口服液）药物组成：当归、生地、桃仁、红花、枳壳、赤芍、柴胡、川芎、牛膝、桔梗、甘草。复方丹参滴丸药物组成：丹参、三七、冰片。速效救心丸药物组成：川芎、冰片。茵栀黄口服液药物组成：茵陈提取物、栀子提取物、黄芩提取物（以黄芩苷计）、金银花提取物。故汤剂与血府逐瘀口服液同时服用属于重复用药。